下列哪个是T细胞淋巴瘤
A. 伯基特淋巴瘤
B. 滤泡性淋巴瘤
C. 免疫母细胞淋巴瘤
D. 滤泡中心细胞型淋巴瘤
E. 曲折核淋巴细胞淋巴瘤

正确答案：E。曲折核淋巴细胞淋巴瘤

解析：曲折核淋巴细胞淋巴瘤（E对）是T细胞淋巴瘤。伯基特淋巴瘤（Burkitt淋巴瘤）（A错）、滤泡性淋巴瘤（B错）和滤泡中心细胞型淋巴瘤（D错）均为B细胞淋巴瘤。免疫母细胞淋巴瘤（C错）可以是B细胞或T细胞淋巴瘤。